区分内外痔的标志是
A. 齿状线
B. 肛梳
C. 痔环
D. 白线
E. 肛直肠线

正确答案：A。齿状线

解析：区分内外痔的标志为齿状线(A对)，白线（D错）为区分肛门内、外括约肌的标志，肛直肠线(E错)为直肠与肛管的分界线。